血压下降是
A. 诊断休克的惟一依据
B. 休克抑制期临床表现
C. 估计体表灌注情况的主要指标
D. 为组织细胞缺氧的重要指标
E. 以上都是

正确答案：B。休克抑制期临床表现

解析：休克代偿期时血压正常或稍高，休克抑制期时血压下降。肢体温度、色泽等能够反映体表灌注情况。但是血压并不是反映休克程度最敏感的指标。掌握“休克”知识点。